二尖瓣狭窄最不可能引起下列哪项变化
A. 左心房扩大
B. 左心室扩大
C. 右心房扩大
D. 左心房肥大
E. 右心室肥大

正确答案：B。左心室扩大

解析：二尖瓣狭窄早期由于左心房的血液流入左心室受阻，而导致左心房压升高，严重狭窄时左心房压需高达20～25mmHg才能使血流通过狭窄的瓣口，使左心室充盈并维持正常的心排出量，因此左心房会出现代偿性肥厚扩张，引起左心房扩大（A对）和肥大（D对）。随着疾病的发展，左心房压增高引起的肺静脉压力增高导致肺动脉压力增高，而肺动脉高压增加右心室负荷，引起右心室肥厚扩张，出现右心衰竭。此时可表现为右心房扩大（C对）和右心室肥大（E对）。二尖瓣狭窄患者超声心动图可见左心室内径正常，或因充盈不足而偏小，收缩活动正常（实用内科学第14版P1518）（B错，为本题正确答案）。